罗拉匹坦制剂的处方如下：【处方】罗拉匹坦0.5g；精制大豆油50g；卵磷脂45g；泊洛沙姆4.0g；油酸钠0.25g；甘油22.5g；注射用水加至1000ml。该制剂是
A. 注射用混悬剂
B. 口服乳剂
C. 外用乳剂
D. 静脉注射乳剂
E. 脂质体注射液

正确答案：D。静脉注射乳剂

解析：本题考查乳状液型注射剂。罗拉匹坦制剂为静脉注射乳剂（D对），用于预防成人原发性和反复发作性成纤维细胞癌的迟发性化疗相关的恶心呕吐。注射用混悬剂（A错）制剂有黄体酮混悬型长效注射剂、罗替戈汀长效混悬型注射剂等。口服乳剂（B错）制剂有鱼肝油乳、榄香烯口服乳等。外用乳剂（C错）制剂有石灰搽剂等。脂质体注射液（E错）制剂有盐酸多柔比星脂质体注射液、盐酸米托蒽醌脂质体注射液等。